维系蛋白质分子中α-螺旋的化学键是
A. 盐键
B. 疏水键
C. 氢键
D. 肽键
E. 二硫键

正确答案：C。氢键

解析：肽键（D错）和二硫键（E错）是维系蛋白质一级结构的化学键。氢键是维系蛋白质二级结构的化学键。盐键（A错）和疏水键（B错）是维系蛋白质三级结构的化学键。α-螺旋结构是常见的蛋白质二级结构，维系蛋白质分子中α-螺旋的化学键是氢键（C对）。